游离性余氯为
A. HOCl和OCl⁻
B. NH₂Cl和HOCl
C. NH₂Cl和NHCl₂
D. HOCl和NHCl₂
E. OCl⁻和NHCl₂

正确答案：A。HOCl和OCl⁻

解析：本题考查游离性余氯。余氯可分为游离性余氯和化合性余氯，游离性余氯如HOCl和OCl⁻（A对BDE错），化合性余氯如NH₂Cl和NHCl₂（C错）。